影响心肌兴奋-收缩耦联的是
A. 钙离子转运异常
B. ATP生成减少
C. 两者均有
D. 两者均无
E. 无

正确答案：C。两者均有

解析：Ca2+是心肌兴奋-收缩耦联过程中的重要因子，钙离子转运异常如肌浆网钙转运功能障碍、胞外Ca2+内流障碍、肌钙蛋白与Ca2+结合障碍均可影响钙稳态，从而影响心肌兴奋-收缩耦联。心肌缺血缺氧时，ATP生成减少，肌质网上Ca2+-ATP酶活性降低，摄取、贮存Ca2+减少，使供给心肌收缩的Ca2+不足，影响心肌兴奋-收缩耦联（AB对，故C为本题正确答案）。